男，56岁的心房颤动患者，突然发生命名物名困难。二周来共发生过5次，每次持续2～15秒。查体无神经系统异常。脑CT无异常。主要累及的血管是
A. 基底动脉系
B. 椎动脉系
C. 颈内动脉系
D. 大脑后动脉
E. 大脑前动脉

正确答案：D。大脑后动脉

解析：患者初步诊断为短暂性脑缺血发作（TIA）。出现发作性命名物名困难，为命名性失语，其中枢部位于优势半球颞中回后部，由大脑后动脉供血（D对）。椎-基底动脉系TIA（AB错）最常表现为眩晕、平衡障碍、眼球运动异常和复视，呈现典型或不典型的脑干缺血综合征（P173）。颈内动脉系（C错）受损包括三类：大脑中动脉TIA可出现对侧肢体偏瘫、偏身感觉障碍和对侧同向偏盲，大脑前动脉（E错）TIA可出现人格和情感障碍、对侧下肢无力，颈内动脉主干TIA主要表现为眼动脉交叉瘫、Horner交叉瘫（P173）。